以下哪个不是慢性龈缘炎的临床表现
A. 牙龈碰触易出血
B. 龈袋加深，探诊深度可超过3mm
C. 部分患者可发展成牙周炎
D. 龈红肿松软
E. 有轻度的附着丧失

正确答案：E。有轻度的附着丧失

解析：健康的龈沟探诊深度一般不超过2～3mm，当牙龈有炎症时，由于组织的水肿或增生，龈沟的探诊深度可达3mm以上，但上皮附着（龈沟底）的位置仍在釉牙骨质界处，临床上不能探到釉牙骨质界，也就是说此时尚无附着丧失，也无牙槽骨吸收，形成的是假性牙周袋。是否有附着丧失是区别牙龈炎和牙周炎的关键指征。掌握“慢性龈炎”知识点。